足三阴经的循行是
A. 从胸走手
B. 从足走腹
C. 从头走足
D. 从手走头
E. 从腹走胸

正确答案：B。从足走腹

解析：十二经脉循行走向总的规律是：足三阴从足走腹胸（B对）。手三阴从胸走手（A错），手三阳从手走头（D错），足三阳从头走足（C错）。